风邪不具有的性质和致病特点是
A. 升发开泄
B. 耗气伤津
C. 善行数变
D. 百病之长
E. 易袭阳位

正确答案：B。耗气伤津

解析：本题考查的是风邪的性质及致病特点。风邪不具有的性质和致病特点是耗气伤津（B错，为本题正确答案）。风邪的性质及致病特点：（1）风为阳邪，其性开泄（A对），易袭阳位（E对）；（2）风邪善行而数变（C对）；（3）风为百病之长（D对）。耗气伤津为暑邪的性质及致病特点。暑邪的性质及致病特点：（1）暑为阳邪，其性炎热；（2）暑性升散，耗气伤津；（3）暑多挟湿。